最可能引起血小板计数减少的抗生素是
A. 青霉素
B. 头孢拉定
C. 阿莫西林/克拉维酸钾
D. 克拉霉素
E. 甲砜霉素

正确答案：E。甲砜霉素

解析：本题考查影响血小板计数的临床意义。最可能引起血小板计数减少的抗生素是甲砜霉素（E对）。氯霉素会引起血小板计数减少，甲砜霉素是氯霉素类抗生素，抗菌谱、抗菌活性与氯霉素相像，不产生再生障碍性贫血，但可抑制红细胞、白细胞和血小板生成。青霉素（A错）、头孢拉定（B错）、阿莫西林（C错）、克拉霉素（D错）不会引起血小板计数减少。